流行性脑脊髓膜炎时，病变主要累及
A. 胶质细胞
B. 神经元
C. 硬脑膜
D. 软脑膜
E. 脑脊液

正确答案：D。软脑膜

解析：从脑组织表面由内向外依次为：脑组织→软脑膜→蛛网膜下腔→蛛网膜→硬脑膜→硬膜外腔→颅骨。流行性脑炎主要累及软脑膜（D对）和蛛网膜，渗出的脓液主要聚积于蛛网膜下腔内，其中的脑脊液（E错）是化脓菌迅速繁殖和播散的场所，病变几乎不累及脑实质（AB错）。由于各种抗生素的问世和临床应用，累及于硬脑膜（C错）的脑炎很少见。